诸寒收引，皆属于
A. 肺
B. 肾
C. 心
D. 肝
E. 脾

正确答案：B。肾

解析：“诸寒收引，皆属于肾”的意思是多种形寒肢冷、肢体蜷缩、筋脉挛急、关节屈伸不利的寒类病证，其病机大多属于肾。这是由于肾为寒水之脏，主温煦蒸腾气化，若其功能虚衰，则失其温化之职，气血凝敛，筋脉失养，故筋脉拘挛、关节屈伸不利（B对）。诸气膹郁，皆属于肺（A错）。诸痛痒疮，皆属于心（C错）。诸风掉眩，皆属于肝（D错）。诸湿肿满，皆属于脾（E错）。